女，37岁。查体发现甲状腺Ⅱ°大，质地中等硬度，表面不光滑，无触痛，颈浅表淋巴结不肿大。患者无心慌、怕热、多汗、易饿等症状，也无怕冷、便秘、体重增加等表现，血检T₃、T₄及TSH正常，TPO-Ab及TG-Ab显著升高。最可能的诊断是
A. 甲状腺癌
B. 亚急性甲状腺炎
C. 慢性淋巴性甲状腺炎
D. 结节性甲状腺肿
E. 甲状腺腺瘤

正确答案：C。慢性淋巴性甲状腺炎

解析：中年女性患者，查体发现甲状腺肿大、质地中等、表面不光滑、无触痛（慢性淋巴细胞性甲状腺炎的典型触诊表现），颈浅表淋巴结不肿大，无心慌、怕热、多汗、易饿等（无甲状腺功能亢进的表现），也无怕冷、便秘、体重增加等（无甲状腺功能减退的表现），查血T₃、T₄及TSH正常，TPO-Ab及TG-Ab显著升高（常提示慢性淋巴细胞性甲状腺炎），考虑诊断为慢性淋巴性甲状腺炎（C对）。慢性淋巴细胞性甲状腺炎又称桥本甲状腺炎（HT），是一种以自身甲状腺组织为抗原的慢性自身免疫性疾病，常表现为无痛性弥漫性甲状腺肿大，质地坚硬，可检出甲状腺过氧化物酶抗体（TPO-Ab）和甲状腺球蛋白抗体（TG-Ab）等多种抗体。甲状腺癌（A错）常有颈淋巴结肿大，TPO-Ab和TG-Ab一般不升高（P695）。亚急性甲状腺炎（B错）常继发于上呼吸道病毒性感染，病前1～3周有病毒感染前驱症状，甲状腺区发生明显疼痛，可放射至耳部，甲状腺触痛明显，早期血清T₃、T₄升高（P692）。结节性甲状腺肿（D错）甲状腺触诊呈结节性肿大，无TPO-Ab和TG-Ab升高。甲状腺腺瘤（E错）无TPO-Ab和TG-Ab升高。